高血压性心脏病左心室增大，其心脏浊音界呈
A. 靴形
B. 梨形
C. 烧瓶形
D. 普大形
E. 心腰部凸出

正确答案：A。靴形

解析：心浊音界向左下增大，心腰部相对凹陷（E错），由正常钝角变为近似直角，心界似靴形（A对）见于左心室增大，如高血压性心脏病导致的左心室肥大；心浊音界向两侧增大，且左界向左下增大，称普大心（D错），见于左、右心室增大，如扩张型心肌病等；胸骨左缘第2、3肋间心界增大，心腰更为丰满或膨出，心界如梨形（B错），见于二尖瓣狭窄等；心包积液时候两侧增大，相对、绝对浊音界几乎相同，并随体位而改变，坐位时心界呈三角形烧瓶样（C错），卧位时心底部浊音增宽。